不会发生恶变的疾病有
A. 白斑
B. 慢性盘状红斑狼疮
C. 扁平苔藓
D. 口腔红斑
E. 复发性阿弗它溃疡

正确答案：E。复发性阿弗它溃疡

解析：本题考查不会发生恶变的疾病。复发性阿弗它溃疡（E错，为本题的正确答案）具有周期性、复发性、自限性，是最常见的口腔黏膜溃疡类疾病，一般不会发生癌变，但对大而深、病程长的溃疡，应警惕癌性溃疡的可能，必要时可以作活检明确诊断。口腔白斑（A对）病的发病与局部因素的长期刺激以及某些全身因素有关，因此该病易癌变，该病患者约3%～5%发生癌变。慢性盘状红斑狼疮（B对）属于癌前状态，有慢性盘状红斑狼疮的报道，病史均在10年左右，癌变率约为0.35%～0.5%。扁平苔藓（C对）属于癌前状态，反复发病会癌变。口腔红斑（D对）属于癌前病变，颗粒性红斑往往是原位癌或早期鳞癌。